不是腋动脉分支的是
A. 胸肩峰动脉
B. 肩胛上动脉
C. 旋肱前动脉
D. 旋肱后动脉
E. 肩胛下动脉

正确答案：B。肩胛上动脉

解析：胸肩峰动脉（A对）、旋肱前动脉（C对）、旋肱后动脉（D对）、肩胛下动脉（E对）均为腋动脉分支。肩胛上动脉（B错，本题正确答案）为甲状颈干的分支。